可引起嗜睡和反应能力降低而影响驾驶安全的抗高组胺药物是
A. 卡马西平
B. 利培酮
C. 氯苯那敏
D. 吲哚美辛
E. 对乙酰氨基酚

正确答案：C。氯苯那敏

解析：本题考查驾驶员用药。氯苯那敏（C对）服用后可引起嗜睡和反应能力降低而影响驾驶员安全。吲哚美辛（D错）可使驾驶员出现视力模糊、耳鸣、复视、注意力下降。利培酮（B错）为抗精神病药。对乙酰氨基酚（E错）肝肾功能不全者慎用。